卡马西平作用特点是
A. 对高热、破伤风、子痫引起的惊厥有效
B. 对癫痫的精神运动性发作疗效好
C. 对三叉神经痛和舌咽神经痛疗效好
D. 对小发作也有疗效
E. 具有抗心律失常作用

正确答案：B、C、E。对癫痫的精神运动性发作疗效好；对三叉神经痛和舌咽神经痛疗效好；具有抗心律失常作用